“满而不痛者，此为痞”载于
A. 《景岳全书》
B. 《内经》
C. 《伤寒论》
D. 《医学正传》
E. 《类证治裁》

正确答案：C。《伤寒论》

解析：《伤寒论·辨太阳病脉证并治下》云：“若心下…但满而不痛者，此为痞，柴胡不中与之，宜半夏泻心汤”在本条中，张仲景创制半夏泻心汤治疗误下所导致的邪热内陷，脾胃受伤，湿浊壅聚之胃痞，并通过硬痛与否把它与结胸进行了鉴别，同时创诸泻心汤治疗不同类型的胃痞，一直为后世医家所效法（C对）。《景岳全书·疮满》：“痞者，痞塞不开之谓；满者，胀满不行之谓。盖满则近胀，而疮则不必胀也”（A错）。